某患者因剧烈腹痛到乡卫生院就诊，因医生诊断、治疗错误，造成该患者功能障碍，经县医疗事故鉴定委员会鉴定为“三级医疗事故”。其家属对鉴定结论持有异议，认为应属“二级医疗事故”。该事故进一步处理解决的正确程序是
A. 接到结论通知书十五日内，向法院提起行政诉讼
B. 由县级医疗事故鉴定委员会重新鉴定
C. 接到结论通知书十五日内，向上一级卫生行政部门申请复议
D. 由当事人所在的医院与患者家属协商解决
E. 此鉴定为最终鉴定结论，上报有关部门备案

正确答案：C。接到结论通知书十五日内，向上一级卫生行政部门申请复议

解析：该患者家属对鉴定结论持有异议，可以自收到首次鉴定结论之日起15日内向医疗机构所在地卫生行政部门提出再次鉴定的申请（C对）。